各段肾小管比较，重吸收量居首位的是
A. 近端小管
B. 髓袢降支细段
C. 髓袢升支细段
D. 远曲小管
E. 集合管

正确答案：A。近端小管

解析：在各段肾小管中，近端小管是最重要的重吸收部位。正常情况下，近端小管（A对）可以重吸收由肾小球滤过的100%的葡萄糖和氨基酸、65%～70%的Na⁺、C1-和水、80%的HCO₃⁻、65%～70%的K⁺、70%的Ca²⁺等。